在病例对照研究中，使用新发病例的主要优点是
A. 需要的样本量较小
B. 减少回忆偏倚
C. 病例好募集
D. 对象容易配合
E. 以上均不是

正确答案：B。减少回忆偏倚

解析：本题考查病例对照研究新发病例的优点。在病例对照研究中，首选的病例类型是新发病例，其优点在于：①新发病例包括不同病情和预后的病人，代表性好；②病人确诊不久即被调查，对有关暴露的回忆信息较为准确可靠，回忆偏倚较小（B对ACDE错），不受各种预后因素的影响；③病历资料容易获得。